生长发育的影响因素中对身高的影响是
A. 遗传因素决定一切
B. 遗传赋予了生长潜力，环境决定生长发育的现实性
C. 基因决定其最终身高
D. 营养决定其最终身高
E. 体育锻炼决定其最终身高

正确答案：B。遗传赋予了生长潜力，环境决定生长发育的现实性

解析：本题考查影响体格生长的因素。影响体格生长的因素：1.遗传因素；2.环境因素（营养、疾病、母亲情况、自然环境、社会环境、家庭环境）。遗传影响儿童体格生长，但遗传潜力的发挥主要取决于环境条件（B对ACDE错），即儿童生长水平是遗传与环境共同作用的结果，遗传决定生长发育的可能性，环境决定生长发育的现实性。遗传、基因、营养等都是重要因素，并不能起决定性作用。